患者，女，37岁。患乳腺癌正在接受化疗，自述在爬楼梯时有呼吸急促和容易疲劳的情况。心电图检查正常，血红蛋白为81g/L(女性正常值:110～150g/L），宜选用的药物是
A. 地高辛
B. 氨茶碱
C. 重组人促红素
D. 重组人粒细胞刺激因子
E. 重组人粒细胞巨噬细胞刺激因子

正确答案：C。重组人促红素

解析：本题考查重组人促红素。根据题干，该患者宜选用的药物是重组人促红素（C对）。重组人促红素为抗贫血药，用于因慢性肾衰竭所致贫血，包括行血液透析、腹膜透析和非透析治疗者。也可用于治疗接受化疗的非髓性恶性肿瘤成人患者的症状性贫血。地高辛（A错）为强心药。氨茶碱（B错）为平滑肌松弛药、利尿药。重组人粒细胞刺激因子（D错）为免疫兴奋药，用于治疗癌症化疗等原因导致中性粒细胞减少症；促进骨髓移植后的中性粒细胞数升高等。重组人粒细胞巨噬细胞刺激因子（E错）为皮肤科用药，用于Ⅱ度烧伤创面。